牙周病的始动因子是
A. 获得性膜
B. 食物残渣
C. 牙菌斑
D. 白垢
E. 牙石

正确答案：C。牙菌斑

解析：本题考查牙周炎病因学。牙周病是菌斑微生物引起的感染性疾病，牙菌斑（C对）是引发牙周病的始动因子。